滥用药物导致奖赏系统反复、非生理性刺激所致的特殊精神状态是
A. 精神依赖
B. 药物耐受性
C. 交叉依赖性
D. 身体依赖
E. 药物强化作用

正确答案：A。精神依赖

解析：本题考查药物依赖性。滥用药物导致奖赏系统反复、非生理性刺激所致的特殊精神状态是精神依赖性（A对）。精神依赖性是指多次用药后使人产生欣快感，导致用药者在精神上对所用药物有一种渴求连续不断使用的强烈欲望，继而引发强迫用药行为，以获得满足和避免不适感，也称为成瘾性。药物耐受性（B错）是指在连续用药过程中，有的药物的药效会逐渐减弱，需加大剂量才能显效的现象。交叉依赖性（C错）是指人体对一种药物产生身体依赖性时，停用该药所引发的戒断综合征可能为另一性质相似的药物所抑制，并维持原已形成的依赖性状态的现象。身体依赖性（D错）是指中枢神经系统对长期使用的药物所产生的一种身体适应状态；一旦停药，将发生一系列生理功能紊乱，称为戒断综合征。药物强化作用（E错）是指驱使用药者连续或定期用药的潜能，属于精神活性药物的一个药理学特点。